药品成份的含量不符合国家药品标准的是
A. 假药
B. 药品
C. 劣药
D. 新药
E. 辅料

正确答案：C。劣药

解析：本题考查劣药。药品成份的含量不符合国家药品标准的是劣药（C对）。根据《药品管理法》第九十八条第三款规定，有下列情形之一的，为劣药：①药品成分的含量不符合国家药品标准；②被污染的药品；③未标明或者更改有效期的药品；④未注明或者更改产品批号的药品；⑤超过有效期的药品；⑥擅自添加防腐剂、辅料的药品；⑦其他不符合药品标准的药品。《药品管理法》第九十八条第一款、第二款规定，禁止生产（包括配制，下同）、销售、使用假药。有下列情形之一的，为假药（A错）：①药品所含成分与国家药品标准规定的成分不符；②以非药品冒充药品或者以他种药品冒充此种药品；③变质的药品；④药品所标明的适应症或者功能主治超出规定范围。药品（B错）是指用于预防、治疗、诊断人的疾病，有目的地调节人的生理机能并规定有适应症或者功能主治、用法和用量的物质，包括中药、化学药和生物制品等。新药（D错）是指未曾在中国境内上市销售的药品。辅料（E错）是指生产药品和调配处方时所用的赋形剂和附加剂。